下列因素与发病率的变化不相关的是
A. 致病因素的作用明显加强和减弱
B. 病死率的升高或下降
C. 疾病诊断水平的提高或下降
D. 诊断标准的变化
E. 防疫措施的有效与否

正确答案：B。病死率的升高或下降

解析：本题考查发病率的影响因素。发病率是指某特定时间内总人口中，某病新发病例所占比例，与发病人数变化相关，受致病因素（A对），疾病诊断水平（C对），诊断标准（D对）及防疫措施（E对）影响。病死率的升高或下降（B错，为本题正确答案）不会引起新发病例数的改变，因此不会引起发病率的变化。某些自然因素、社会因素的变化可使发病率升高，某些有效的防制措施的实施可使其下降。